某毒理学安全性评价机构受厂家委托，对一新研发的喷洒用消毒剂做急性吸入毒性试验，共选用体重为18～22g的昆明种小鼠60只，分为6个剂量组，每组10只，雌雄各半，所得剂量-反应关系曲线形式多为
A. 直线
B. U形曲线
C. 对称S状曲线
D. 非对称S状曲线
E. 抛物线

正确答案：D。非对称S状曲线